药物与受体的结合一般是通过
A. 氢键
B. 疏水键
C. 共轭作用
D. 电荷转移复合物
E. 静电引力

正确答案：A、B、D、E。氢键；疏水键；电荷转移复合物；静电引力

解析：本题考查药物与生物大分子相互作用的方式。药物在和生物大分子作用一般是通过键合的形式，包括共价键和非共价键两大类。共价键是两个或两个以上原子通过共用电子对形成的化学键。非共价键是可逆的结合形式，包括：范德华力、氢键（A对）、疏水键（B对）、电荷转移复合物（D对）、静电引力（E对）、偶极相互作用力等。共轭作用（C错）又称离域效应，是指共轭体系中由于原子间的相互影响而使体系内的π电子 （或p电子）分布发生变化的一种电子效应。